单纯餐后血糖升高患者宜选用
A. 胰岛素
B. 二甲双胍
C. 格列喹酮
D. 瑞格列奈
E. 阿卡波糖

正确答案：E。阿卡波糖

解析：本题考查降糖药。单纯餐后血糖升高患者宜选用阿卡波糖（E对）。胰岛素（A错）用于1型糖尿病患者的胰岛素分泌不足。二甲双胍（B错）用于2型肥胖型糖尿病患者。格列喹酮（C错）用于糖尿病合并肾病。瑞格列奈（D错）在2型非肥胖型糖尿病患有良好的胰岛β细胞储备功能、无高胰岛素血症时应用。